促进皮质醇分泌的激素是
A. TSH
B. ACTH
C. LH
D. GH
E. FSH

正确答案：B。ACTH

解析：促进皮质醇分泌的激素是促肾上腺皮质激素（ACTH）（B对）。促甲状腺激素（TSH）可以促进甲状腺激素的分泌（A错）。黄体生成素（LH）和卵泡刺激素（FSH）可以促进雌激素的分泌（CE错）。生长激素（GH）可以促进人的生长发育（D错）。